下列不属于细胞膜受体的是
A. 生长因子
B. 细胞因子
C. 水溶性激素
D. 类固醇激素
E. 黏附分子

正确答案：D。类固醇激素

解析：受体可分为细胞膜受体和胞内受体两类。细胞膜受体接收的是不能进入细胞的水溶性化学信号（生长因子、细胞因子、水溶性激素等）和位于邻近细胞表面分子的信号（黏附分子等），需要一复杂的信号跨膜传递和转换过程。而胞内受体接收的是可以直接通过脂双层质膜进入细胞的脂溶性化学信号，如类固醇激素、甲状腺素、维甲酸等。掌握“各信号分子及转导机制”知识点。